对Ⅰ和Ⅱ型单纯性疱疹病毒有高度选择性的抗病毒药是
A. 利巴韦林
B. 干扰素
C. 聚肌胞
D. 阿昔洛韦
E. 胸腺素

正确答案：D。阿昔洛韦

解析：本题考查单纯疱疹病毒的全身抗病毒治疗。对Ⅰ和Ⅱ型单纯性疱疹病毒有高度选择性的抗病毒药是阿昔洛韦（D对）。单纯性疱疹是由单纯性疱疹感染引起，单纯疱疹的治疗应为全身抗病毒治疗、局部治疗、对症和支持治疗及中医中药治疗。利巴韦林为合成的核苷类抗病毒药，对呼吸道合胞病毒（RSV）具有选择性抑制作用（A错）。干扰素（IFN）是一种广谱抗病毒剂，作用无特异性，对多数病毒均有一定抑制作用（B错）。聚肌胞为一种干扰素诱导剂，在体内细胞诱导下产生干扰素，有类似干扰素的作用，故有广谱抗病毒和免疫调节功能，用于病感染性疾病和肿瘤的辅助治疗（C错）。胸腺素可增强细胞免疫功能（E错）。